└Ⅴ表示
A. 右上颌第一乳磨牙
B. 右上颌第一前磨牙
C. 左上颌第一乳磨牙
D. 左上颌第二乳磨牙
E. 左上颌第一前磨牙

正确答案：D。左上颌第二乳磨牙

解析：└表示左上颌，Ⅴ表示第二乳磨牙，故└Ⅴ表示左上颌第二乳磨牙(D对)。